氨苄西林、阿莫西林、匹氨西林的特点为
A. 广谱抗菌药
B. 对G⁺菌作用不及青霉素
C. 对绿脓杆菌有效
D. 对G⁻杆菌作用强，但有耐药性
E. 炎症时，脑脊液难达到有效血药浓度

正确答案：A、B、D。广谱抗菌药；对G⁺菌作用不及青霉素；对G⁻杆菌作用强，但有耐药性